对医疗事故所作首次鉴定结论不服的，当事人申请再次鉴定的时限应是
A. 收到首次鉴定结论之日起30日后
B. 收到首次鉴定结论之日起20日后
C. 收到首次鉴定结论之日起15日后
D. 收到首次鉴定结论之日起15日内
E. 收到首次鉴定结论之日起10日内

正确答案：D。收到首次鉴定结论之日起15日内

解析：医患双方协商解决医疗事故争议，需要进行医疗事故技术鉴定的，由双方当事人共同委托，负责医疗事故技术鉴定工作的医学会组织鉴定。当事人对首次医疗事故技术鉴定结论不服的，可以自收到首次鉴定结论之日起15日内（D对）向医疗机构所在地卫生行政部门提出再次鉴定的申请。